适用于一切溃疡或烧伤，腐肉未脱，新肉未生之时的外治首选方是
A. 金黄油膏
B. 冲和油膏
C. 生肌玉红膏
D. 回阳玉龙膏
E. 青黛散油膏

正确答案：C。生肌玉红膏

解析：生肌玉红膏功能活血祛腐、解毒止痛、润肤生肌收口，适用于一切溃疡腐肉未脱、新肉未生之时，或日久不能收口者（C对）。金黄膏长于除湿化痰，对肿而有结块，尤其是急性炎症控制后形成的慢性迁延性炎症更为适宜（A错）。冲和膏有活血止痛、疏风祛寒、消肿软坚的作用，适用于半阴半阳证（B错）。回阳玉龙膏有温经散寒、活血化瘀的作用，适用于阴证（D错）。青黛散油膏功能收湿止痒、清热解毒，适用于蛇串疮及急、慢性湿疮等皮肤掀红痒痛、渗液不多者，亦可用于痄腮以及对各种油膏过敏者（E错）。